外源化学物在胎儿期和新生儿期的主要影响是
A. 着床减少
B. 器官畸形
C. 胚胎死亡
D. 发育迟缓和功能紊乱
E. 以上都不是

正确答案：D。发育迟缓和功能紊乱